阴虚风动可见
A. 眩晕欲仆
B. 目睛上吊
C. 手足蠕动
D. 手足拘挛不伸
E. 皮肤瘙痒

正确答案：C。手足蠕动

解析：阴虚动风则阴液亏虚，筋膜失养进一步导致手足蠕动（C对）。眩晕欲仆见于肝阳化风（A错）。目睛上吊见于热极生风（B错）。手足拘挛不伸见于血虚生风（D错）。皮肤瘙痒见于血燥生风（E错）。